下面哪个机构负责对艾滋病发生、流行以及影响其发生、流行的因素开展检测活动
A. 卫生行政主管部门
B. 医疗卫生机构
C. 疾病预防控制机构
D. 出入境检验检疫机构
E. 艾滋病监测机构

正确答案：C。疾病预防控制机构